含有对乙酰氨基酚和马来酸氯苯那敏的是
A. 强力感冒片
B. 维C银翘片
C. 羚羊感冒片
D. 感冒退热颗粒
E. 新复方大青叶片

正确答案：B。维C银翘片

解析：本题考查的是含西药组分的中成药。含有对乙酰氨基酚和马来酸氯苯那敏的是维C银翘片（B对）。维C银翘片：功能疏风解表，清热解毒。用于外感风热所致流行性感冒，症见发热、头痛、咳嗽、口干、咽喉疼痛。含西药成分：对乙酰氨基酚、马来酸氯苯那敏、维生素C。强力感冒片（A错）：功能疏风解表，清热解毒。用于风热感冒，症见发热、头痛、口干、咳嗽、咽喉痛。含西药成分：对乙酰氨基酚。新复方大青叶片（E错）：功能清瘟，消炎，解热。用于伤风感冒，发热头痛，鼻流清涕，骨节酸痛。含西药成分：对乙酰氨基酚、异戊巴比妥、咖啡因、维生素C。羚羊感冒片（C错）与感冒退热颗粒（D错）的成分，2022年考试指南未明确说明。